属于保钾利尿药的是
A. 氢氯噻嗪
B. 螺内酯
C. 甘露醇
D. 呋塞米
E. 乙酰唑胺

正确答案：B。螺内酯

解析：本题考查保钾利尿药。属于保钾利尿药的是螺内酯（B对）。保钾利尿药包括螺内酯、氨苯蝶啶、阿米洛利等。氢氯噻嗪（A错）为中效利尿药。甘露醇（C错）为渗透性利尿药。呋塞米（D错）为高效利尿剂。乙酰唑胺（E错）碳酸酐酶抑制剂。